关于口腔局麻药物，描述不正确的是
A. 阿替卡因属于酯类局麻药
B. 普鲁卡因和丁卡因属于酯类局麻药
C. 布比卡因属于酰胺类局麻药
D. 口腔局麻药可分为酯类和酰胺类
E. 利多卡因属于酰胺类局麻药

正确答案：A。阿替卡因属于酯类局麻药

解析：本题考查口腔局麻药物。关于口腔局麻药物，描述不正确的是阿替卡因属于酯类局麻药（A错，为本题的正确答案）。阿替卡因属于酰胺类局麻药；普鲁卡因和丁卡因为酯类局麻药（B对）；布比卡因、利多卡因属于酰胺类局麻药（CE对）；局麻药的种类按化学结构分为酯类和酰胺类（D对）。